男性，32岁，劳累后心悸、气促、下肢水肿6个月，查体心界向两侧扩大，心尖区闻及2/6级收缩期杂音，两肺底有小水泡音，超声心动图示左室腔增大，心电图提示完全性左束支阻滞。该患者诊断为
A. 心包炎
B. 扩张型心肌病
C. 急性病毒性心肌炎
D. 二尖瓣狭窄
E. 肺心病

正确答案：B。扩张型心肌病

解析：患者中青年男性，劳累后心悸、气促、下肢水肿等心衰症状，心尖区可闻及收缩期杂音，两肺底有小水泡音（湿啰音），超声心动图示左室腔增大。根据患者病史、临床表现和影像学检查，考虑诊断为扩张型心肌病（B对）。心包炎（A错）可有心界扩大，但一般不会出现心室腔增大。急性病毒性心肌炎（P270）（C错）患者发病前多有病毒感染前驱症状，如发热、全身倦怠感和肌肉酸痛等。二尖瓣狭窄（P287）（D错）特征性杂音为心尖区舒张中晚期低调的隆隆样杂音，而不是收缩期杂音。肺心病（E错）患者多先有慢阻肺或慢性支气管炎、肺气肿等肺部疾病，然后出现右心衰征象。